患儿，男，5岁。右颌下肿痛3天，灼热，皮色微红，伴恶寒发热，纳呆，舌红苔薄黄，脉滑数。其诊断是
A. 脊核
B. 颈痈
C. 烂疔
D. 流注
E. 红丝疔

正确答案：B。颈痈

解析：颈痈是发生在颈部两侧的急性化脓性疾病，其特点是多见于儿童，冬春易发，初起时局部结块、肿胀、灼热、疼痛而皮色不变（多发生在颈旁两侧，也可发生于耳后、颈后、颔下、颏下），结块边界清楚，具有明显的风温外感症状，多伴寒热、舌苔黄腻、脉滑数等症状，相当于西医的颈部急性化脓性淋巴结炎。本病例患儿临床表现与之相符，故诊断为颈痈（B对）。脊核（A错）即骨结核，是由结核杆菌侵入骨或关节而引起的破坏性病变，临床表现除有低热、倦怠、盗汗、食欲减退和消瘦等一般表现外，尚可出现关节功能障碍、局部肿胀、疼痛，甚至畸形。烂疔（C错）是发生于皮肉之间、腐烂甚剧、病势暴急的急性化脓性疾病，其特点是来势急骤凶险，焮热肿胀、疼痛彻骨，肿胀迅速蔓延，极易化腐，患处皮肉很快大片腐烂卸脱，范围甚大，疮形略带凹形，流出脓液稀薄如水、臭秽，易并发走黄，危及生命，相当于西医的气性坏疽。流注（D错）是发生于肌肉深部的急性化脓性疾病，相当于西医的脓血症、多发性肌肉深部脓肿及髂窝部脓肿，其特点是好发于四肢躯干肌肉丰厚处的深部或髂窝部，发病急骤，局部漫肿疼痛，皮色如常，容易走窜，常见此处未愈，他处又起。红丝疔（E错）是发生于四肢，皮肤呈红丝显露，迅速向上走窜的急性感染性疾病，相当于西医的急性淋巴管炎。